我国药品监督管理部门发布的药物警戒信息有
A. 特非那定能增加室性心律失常风险，停止生产、销售和使用
B. 头孢曲松不宜与含钙注射液直接混合
C. 阿昔洛韦可引起急性肾衰竭
D. 停止生产、销售和使用盐酸芬氟拉明
E. 吡格列酮会加重充血性心力衰竭而增加黑框警示

正确答案：B、C、D、E。头孢曲松不宜与含钙注射液直接混合；阿昔洛韦可引起急性肾衰竭；停止生产、销售和使用盐酸芬氟拉明；吡格列酮会加重充血性心力衰竭而增加黑框警示

解析：本题考查我国药物警戒信息的内容。我国药物警戒信息有：1.SFDA警告头孢曲松不宜与含钙注射液直接混合（B对）；2.SFDA修订盐酸吡格列酮制剂说明书，增加有关充血性心力衰竭的黑框警告内容（E对）；3.SFDA修订阿昔洛韦制剂说明书，增加框警示阿昔洛韦可引起急性肾衰竭（C对）；4.SFDA发布关于停止生产、销售和使用盐酸芬氟拉明（D对）的公告；5.SFDA修订多巴胺受体激动剂制剂说明书；6.SFDA修订拉莫三嗪片说明书。